心室肌细胞4期动作电位的主要离子流是
A. Ca²⁺内流
B. Cl⁻内流
C. Na⁺泵离子流
D. Na⁺内流
E. K⁺外流

正确答案：C。Na⁺泵离子流